深龋去腐时有明显主观感觉，则首先需要处理的是
A. 安抚
B. 垫底充填
C. 间接盖髓术
D. 直接盖髓术
E. 根管治疗术

正确答案：A。安抚

解析：本题考查龋病的治疗原则与非手术治疗方法。深龋近髓，若去腐时不能完全清楚，则首先需要进行安抚（A对）。